脐平面以下浅感觉消失，可能损伤的脊髓节段是
A. 第4节胸髓
B. 第7节胸髓
C. 第10节胸髓
D. 第12节胸髓
E. 第2节腰髓

正确答案：C。第10节胸髓

解析：第10节胸髓（C对）相当于脐平面，有胸神经前支通过，损伤后导致脐平面以下浅感觉消失。